制作固定义齿需要等待伤口愈合的适合时间是在拔牙后
A. 1个月
B. 2个月
C. 3个月
D. 3～6个月
E. 1年以上

正确答案：C。3个月

解析：缺牙区的牙槽嵴在拔牙或者手术后3个月完全愈合，牙槽嵴的吸收趋于稳定，可以制作固定桥。掌握“固定桥的适应证与禁忌证”知识点。